某男，40岁。症见恶寒，无汗，周身关节酸痛，鼻塞，流涕，舌苔薄白，脉浮紧，治疗应选用
A. 银翘散
B. 麻黄汤
C. 藿香正气散
D. 玉屏风散
E. 荆防败毒散

正确答案：E。荆防败毒散

解析：风寒之邪外束肌表，卫阳被遏，故见恶寒，无汗；清阳不展，络脉失和，故见周身关节酸痛，鼻塞，流涕；舌苔薄白，脉浮紧，均为风寒束表证的感冒表现，治疗需辛温解表，方药选用荆防败毒散加减（E对）。银翘散（A错）可以辛凉透表，清热解毒，用于治疗温病初起的发热无汗，或有汗不畅，微恶风寒，头痛口渴，咳嗽咽痛。麻黄汤（B错）解表散寒，宣肺平喘，用于治疗风寒表实证。藿香正气散（C错）可以解表化湿，理气和中，用于治疗外感风寒，内伤湿滞证的霍乱吐泻，发热恶寒，头痛，胸膈满闷，脘腹疼痛。玉屏风散（D错）可以益气固表，用于治疗肺卫气虚证。